患者，男，60岁。有长期饮酒史，现症腹大胀满，青筋显露，牙龈出血，口干咽燥，心烦失眠，小便短少，舌红少津，脉细数。其证候是
A. 湿热蕴结
B. 寒湿困脾
C. 脾肾阳虚
D. 肝脾血瘀
E. 肝肾阴虚

正确答案：E。肝肾阴虚

解析：题中患者有长期饮酒史，酿湿生热，蕴聚中焦，清浊相混，壅阻气机，水谷精微失于输布，湿浊内聚，日久发为鼓胀。腹大胀满，或见青筋暴露为肝肾阴虚，津液失于输布，气、血、水积于腹中所致；阴虚失润，虚热内炽，故口干咽燥，心烦失眠，小便短少；阴虚则络脉失养，虚热灼伤络脉，故时或鼻衄，牙龈出血；舌红少津，脉细数为阴虚之象，故辨为肝肾阴虚证。湿热蕴结者腹大坚满，脘腹胀急，多有面、目、皮肤发黄，烦热口苦，大便秘结或溏垢，苔多黄腻（A错）。寒湿困脾者腹大胀满，按之如囊裹水，精神困倦，怯寒懒动，可伴颜面下肢浮肿，苔白腻（B错）。脾肾阳虚者腹大胀满，形似蛙腹，多伴面色苍黄，脘闷纳呆，神倦怯寒，肢冷浮肿，舌体胖，苔淡白，脉多沉细无力（C错）。肝脾血瘀者脘腹坚满，胁下癥结痛如针刺，面色晦暗黧黑，面、颈、胸、臂出现血痣，口干不欲饮水，舌紫黯或有紫斑，脉细涩（D错）。题中辨为肝肾阴虚证（E对）。